毛花洋地黄苷A与紫花洋地黄苷A结构上差异是
A. 羟基位置异构
B. 糖上有乙酰基取代
C. 苷键构型不同
D. C₁₇内酯环不同
E. C14-OH构型不同

正确答案：B。糖上有乙酰基取代

解析：本题考查的是强心苷的酶水解。毛花洋地黄苷A与紫花洋地黄苷A结构上差异是糖上有乙酰基取代（B对）。强心苷的酶水解：酶水解有一定的专属性。不同性质的酶，作用于不同性质的苷键。在含强心苷的植物中，有水解葡萄糖的酶，但无水解α-去氧糖的酶，所以能水解除去分子中的葡萄糖，而得到保留α-去氧糖的次级苷。强心苷的苷元类型不同，被酶解难易程度也不同。毛花洋地黄苷和紫花洋地黄毒苷用紫花苷酶酶解，前者糖基上有乙酰基，对酶作用阻力大，故水解慢，后者水解快。一般来说，乙型强心苷较甲型强心苷易被酶水解。